树突状细胞的表面分子
A. CD3
B. CD19
C. KIR
D. MHC-Ⅱ
E. IL-2

正确答案：D。MHC-Ⅱ

解析：树突状细胞广泛分布在全身组织和脏器，是专职抗原提呈细胞，主要功能是摄取、加工处理和提呈抗原，从而启动适应性免疫应答，未成熟的DC高表达IgG Fc受体、C3b受体、甘露糖受体和某些TLR，成熟的DC高表达MHC-Ⅱ（D对）类分子和共刺激分子，可有效提呈抗原、激活初始T细胞启动适应性免疫应答。CD3（A错）是T细胞表面分子。CD19（B错）是B细胞表面分子。KIR（C错）是NK细胞的表面分子。IL-2（E错）是所有T细胞亚群的生长因子。